生物-心理-社会医学模式对卫生服务的影响归为4个扩大，即
A. 从治疗到预防、从院内到院外、从个体到群体、从生理到心理
B. 从预防到治疗、从技术服务到社会服务、从无偿到有偿、从个体到群体
C. 从预防到治疗、从低效到高效、从局部到整体、从生理到心理
D. 从治疗到预防、从技术服务到社会服务、从院内到院外、从生理到心理
E. 从治疗到预防、从局部到整体、从院内到院外、从生理到心理

正确答案：D。从治疗到预防、从技术服务到社会服务、从院内到院外、从生理到心理

解析：本题考查生物-心理-社会医学模式对卫生服务的影响。生物-心理-社会医学模式对卫生服务的影响可归纳为4个扩大，即从治疗服务扩大到预防保健服务，从生理服务扩大到心理服务，从院内服务扩大到院外服务，从技术服务扩大到社会服务（D对ABCE错）。